28岁，未孕。继发性痛经5年，宫右后方7cm囊肿，按压有压痛。最佳的治疗方法是
A. 药物治疗
B. 保留生育功能手术
C. 根治性手术
D. 饮食注意
E. 无需处理

正确答案：B。保留生育功能手术

解析：该患者为育龄期妇女，继发性痛经5年，宫右后方7cm囊肿，按压有压痛（卵巢内膜异位囊肿多发生于育龄期妇女，典型症状为继发性痛经、进行性加重。囊肿较大时，妇科检查可扪及与子宫粘连的肿块），应诊断为卵巢内膜异位囊肿。患者囊肿较大，且未孕有生育要求，最佳治疗方法是保留生育功能手术（B对）。药物治疗（P272）（A错）适用于有慢性盆腔痛、经期痛经症状明显、有生育要求及无卵巢囊肿形成者。根治手术（C错）将子宫、双附件及盆腔内所有异位内膜病灶予以切除和清除，适用于45岁以上重症患者。饮食注意（D错）、无需处理（E错）仅适用于轻度内异症患者。